患者高热1周。检查：体温40℃，脉搏90次/分，血白细胞4.0×109/L，嗜酸性粒细胞消失。应首先考虑的是
A. 伤寒
B. 中毒性痢疾
C. 中毒性肺炎
D. 流行性脑脊髓膜炎
E. 急性病毒性肝炎

正确答案：A。伤寒

解析：患者高热1周，体温40℃（高热：39.1～41℃），脉搏90次/分（正常60～100次/分，高热但脉搏正常，提示相对缓慢），血白细胞4.0×109/L（正常4～10×109/L，伤寒时白细胞常在3～5×109/L之间），嗜酸性粒细胞消失，综合该患者的病史、体查、血象检查，应首先考虑的是伤寒（A对）。中毒性痢疾（八版传染病学P180）（B错）起病骤急，表现为突然寒战、高热，全身中毒症状严重，可有嗜睡、昏迷及抽搐，检查见血白细胞增多。中毒性肺炎（C错）主要表现为肺部感染和休克，常有咳嗽、咳痰，伴血压下降、四肢湿冷和脉搏细速等。流行性脑脊髓膜炎（八版传染病学P208-P207）（D错）起病急，常有剧烈头痛，喷射性呕吐，伴皮肤黏膜淤点、淤斑，白细胞总数明显升高。急性病毒性肝炎（八版传染病学P28-P29）（E错）主要表现为黄疸、全身乏力、食欲下降、恶心以及腹胀等。